骨盆最小平面其前方是耻骨联合下缘，两侧为坐骨棘，后方是
A. 第4～5骶椎间
B. 骶骨相应部位
C. 第3～4骶椎间
D. 骶尾关节
E. 骶岬

正确答案：B。骶骨相应部位

解析：骨盆最小平面其前方是耻骨联合下缘，两侧为坐骨棘，后方是骶骨相应部位（B对）。